当一种疾病的分布与另一种病因已清楚的疾病的分布相似时，则这两种病可能有共同的病因
A. 求同法
B. 求异法
C. 共变法
D. 类推法
E. 假说

正确答案：D。类推法

解析：本题考查类推法。当一种疾病的分布与另一种病因已清楚的疾病的分布相似时，则这两种病可能有共同的病因，属于类推法（D对ABCE错）。类推法是通过不同事物的某些相似性类推出其他的相似性，从而预测出它们在其他方面存在类似的可能性。